患者男性18岁，右下颌角隆起，右下8未萌出，右下87舌侧膨隆明显肿物，X线显示右下765根尖下方5.0cm×3.0cm圆形低密度影，边界清楚，沿颌骨长轴发展。该病最可能的诊断是
A. 根尖囊肿
B. 含牙囊肿
C. 角化囊性瘤
D. 孤立性骨囊肿
E. 牙源性钙化囊肿

正确答案：C。角化囊性瘤

解析：本题考查牙源性颌骨囊肿。牙源性角化囊肿（C对）的X线表现为：①有单囊和多囊之分，单囊多见，也可为多房；多房者分房大小相近。②常沿颌骨长轴生长，膨胀不明显；如有膨胀，常向舌侧。③牙根吸收少见，多呈斜面状。④病变内可含牙或不含牙。